男性，40岁，腹痛发热48小时，血压80/60mmHg，神志清楚面色苍白，四肢湿冷，全腹肌紧张，肠鸣音消失，诊断为
A. 低血容量性休克
B. 感染性休克
C. 神经源性休克
D. 心源性休克
E. 过敏性休克

正确答案：B。感染性休克

解析：患者腹痛、发热、全腹肌紧张、肠鸣音消失提示急性腹膜炎，四肢湿冷、面色苍白、血压低提示休克，应诊断为感染性休克（B对）。低血容量性休克（A错）常因大量出血或体液丢失引起；神经源性休克（C错）不常见，且不会出现腹痛、腹肌紧张等症状；心源性休克（D错）见于心功能不全及心力衰竭患者；过敏性休克（E错）的患者有过敏史，且有再次接触过敏原的现病史。